患者，男，45岁。无节律性上腹部疼痛不适2个月，食欲不振。多次大便隐血实验均为阳性。为确诊应做的捡查是
A. 胃肠X线
B. 胃镜
C. 胃液分析
D. 腹腔镜
E. 癌胚抗原

正确答案：B。胃镜

解析：临床上若中老年人出现无节律性上腹部疼痛，伴有大便隐血试验阳性者，应首选胃镜（B对）进行检查，以排除胃癌的可能。胃肠X线（A错）为胃癌的主要检查方法，主要对于检出胃壁微小病变很有价值。胃液分析（C错）对胃癌的诊断意义不大，一般不列入常规检查。腹腔镜（D错）创口较大，不作为首选。癌胚抗原（E错）对本病的诊断与预后有一定价值。